舌红绛而光者，见于
A. 阴虚
B. 气虚
C. 血虚
D. 气阴两虚
E. 水涸火炎

正确答案：E。水涸火炎

解析：绛舌多由红舌进一步发展而成。其形成的原因是热入营血，气血沸涌，耗伤营阴，血液浓缩；或虚火旺盛，上炎于舌络，血络充盈，故舌呈绛色。舌绛少苔或无苔，或有裂纹，多属久病阴虚火旺，或热病后期阴液耗损（E对）。阴虚（A错），指阴液亏虚，虚火上炎，而舌失津液滋润，故舌色鲜红而少苔，或有裂纹，病情较轻；水液干涸火热上炎时舌光无苔，病情较重。气血俱虚（B、C错），多见淡白舌，嫩舌，瘦薄舌，萎软舌，颤动舌，短缩舌。血虚不润还可见裂纹舌。气血亏虚，阴液亏损（D错），舌体肌肉筋脉失去濡养而废弛，可见萎软舌。